艾滋病常表现为哪些器官的症状
A. 肺部、胃肠系统、神经系统、皮肤黏膜、眼部
B. 肺部、循环系统、神经系统、皮肤黏膜、眼部
C. 血管、肾脏、心脏、脑垂体
D. 肝、肾、神经、皮肤黏膜
E. 全身各脏器

正确答案：A。肺部、胃肠系统、神经系统、皮肤黏膜、眼部

解析：艾滋病各系统常见的机会性感染如下（A对BCDE错）：①呼吸系统：肺孢子菌肺炎是常见的艾滋病机会性感染和指征性疾病；肺结核常是HW感染者的首发感染；复发性细菌和真菌性肺炎临床表现可见发热、咳嗽、咳痰、胸痛、乏力等症状。②中枢神经系统：隐球菌脑膜炎亦是艾滋病指征性疾病，临床症状以发热、疲劳不适、头痛为主，结核性脑膜炎、各种病毒性脑膜脑炎和弓形虫脑病，主要表现为神经精神症状和体征。③消化系统：白色念珠菌食管炎表现为咽下困难，吞咽疼痛，胸骨后疼痛或烧灼感，或恶心呕吐，消痩，低热。巨细胞病毒性食管炎主要症状为吞咽疼痛和胸痛，内镜下可见食管黏膜有溃疡形成。巨细胞病毒性肠炎常表现为腹泻，腹痛，体重减轻，食欲下降和发热，肠镜可见肠黏膜弥漫性充血、黏膜下出血和溃疡形成。沙门菌、痢疾杆菌、空肠弯曲菌肠炎多以腹泻，腹痛，发热为主。隐孢子虫性肠炎表现为慢性顽固性腹泻，间歇性水样便，伴低热、上腹疼痛、厌食、腹胀、疲劳等症状。④口腔：常见鹅口疮及舌毛状白斑，亦可见复发性口腔溃疡，牙龈炎等。⑤皮肤：常见带状疱疹、传染性软疣传染性软疣。尖锐湿疣、真菌性皮炎、甲癖亦较常见。⑥眼部：可见巨细胞病毒性视网膜炎、弓形虫性视网膜炎等。